与细菌耐药性有关的结构是
A. 性菌毛
B. 细菌染色体
C. 质粒
D. 鞭毛
E. 异染颗粒

正确答案：C。质粒

解析：质粒（C对）是细菌染色体外的遗传物质，存在于细胞中，与细菌耐药性有关。性菌毛（A错）又称F菌毛，仅见于少数革兰阴性菌，参与接合过程，可传递细菌的致育性（编码性菌毛的能力）、毒力、耐药性等，同时也是某些噬菌体吸附于细菌细胞的受体（P20）。核质又称为拟核，是细菌的遗传物质，功能与真核细胞染色体相似，亦称为细菌的染色体（B错）（P17）。鞭毛（D错）是某些细菌菌体周围附着的细长并呈波状弯曲的丝状物，是细菌的运动器官，有些鞭毛与细菌的致病性有关，也可用于鉴定细菌和进行细菌分类（P18-P19）。异染颗粒（E错）是白喉棒状杆菌的生物学特性，主要成分是核糖核酸和多偏磷酸盐，对鉴定细菌具有重要意义（P164）。